鳃弓的出现是在
A. 胚胎发育第3周
B. 胚胎发育第4周
C. 胚胎发育第5周
D. 胚胎发育第6周
E. 胚胎发育第7周

正确答案：B。胚胎发育第4周

解析：口腔颌面部的发育与鳃弓和咽囊有密切的关系。胚胎发育到第4周时，在胚体头部两侧出现6对柱状弓形隆起，称为鳃弓。掌握“鳃弓与神经嵴”知识点。